竹沥的功效是
A. 清热滑痰
B. 消痰软坚
C. 燥湿化痰
D. 敛肺平喘
E. 泻肺平喘

正确答案：A。清热滑痰

解析：本题考查的是竹沥的功效。竹沥的功效是清热滑痰（A对）。竹沥：【功效】清热滑痰。海藻：【功效】消痰软坚（B错），利水消肿。白附子：【功效】燥湿化痰（C错），祛风止痉，解毒散结。白果：【功效】敛肺平喘（D错），止带缩尿。桑白皮：【功效】泻肺平喘（E错），利水消肿。